男，59岁。晨起轻微头痛和发现左侧肢体无力。左侧Babinskin征阳性，左侧肢体痛温觉消失。可能的诊断是
A. 脑出血
B. 脑血栓形成
C. 高血压脑病
D. 脑膜瘤
E. 脑栓塞

正确答案：B。脑血栓形成

解析：患者老年男性，晨起轻微头痛和发现左侧肢体无力（TIA前驱症状），左侧Babinskin征阳性（锥体束受损），左侧肢体痛温觉消失，考虑脑血栓形成（B对）可能性大。脑血栓形成多见于中老年，一般有高血压、糖尿病等血管慢性损害疾病，常在安静或睡眠中发病，多有肢体麻木、无力等短暂性脑缺血发作（TIA）前驱症状，患者一般意识清楚，临床表现因血栓形成部位不同而有差异。脑出血（A错）多在情绪激动或活动中突然发病，前驱症状一般不明显，有明显头痛、呕吐症状（P189）。高血压脑病（C错）会有头痛、呕吐、视乳头水肿等颅内压增高表现。脑膜瘤（D错）属于良性肿瘤，生长慢，病程长，因肿瘤呈膨胀性生长，病人往往以头疼和癫痫为首发症状。脑栓塞（E错）以青壮年多见，多在活动中急骤发病，无前驱症状，多表现为完全性卒中，且有栓子来源病史（P185）。